决定肺部气体交换方向的主要因素是
A. 气体的溶解度
B. 气体的分压差
C. 肺泡膜的通透性
D. 气体分子量的大小
E. 气体与血红蛋白的亲和力

正确答案：B。气体的分压差

解析：气体分子不停地进行无定向的运动，当不同区域存在气压差时，气体分子将从气压高处向气压低处发生净转移，直至取得动态平衡，因此气体的分压差（B对）是气体扩散的动力和决定肺部气体交换方向的主要因素。气体的溶解度（A错）、肺泡膜的通透性（C错）、气体分子量的大小（D错）、气体与血红蛋白的亲和力（E错）均可以影响气体的交换，但都不是决定肺部气体交换方向的主要因素。